男性患者，55岁，就诊时面容痛苦，诉右上后牙剧痛不敢咬合轻碰即痛。查见：右上6相对根尖区牙龈肿胀，移行沟变浅，扪诊有深部波动感。右上6叩（+++）松Ⅲ度，可探及髓腔，无反应，右上7牙体完好，颊侧可探及根分叉，无法探入，叩（++）松Ⅲ度。右侧面颊肿胀，触痛，主诉牙应诊断为
A. 急性蜂窝织炎
B. 间隙感染
C. 骨膜下脓肿
D. 颌骨骨髓炎
E. 黏膜下脓肿

正确答案：C。骨膜下脓肿

解析：本题考查急性化脓性根尖周炎的临床表现-骨膜下脓肿。根据题目中的信息该患者就诊时面容痛苦，诉右上后牙剧痛不敢咬合轻碰即痛；检查发现右上6相对根尖区牙龈肿胀，移行沟变浅，扪诊有深部波动感；右上6叩（+++），松Ⅲ度，可探及髓腔，无反应，可诊断为骨膜下脓肿（C对）。骨膜下脓肿时，严重的病例可在相应的颌面部出现蜂窝织炎，表现为软组织肿胀、压痛，致使面容改变，可引起眶下间隙感染、面部肿胀，患者并无这些临床表现，所以为（ABD错），黏膜下脓肿，疼痛减轻，肿胀明显局限，全身症状消退。叩痛为（++）～（+）,扪诊轻痛，浅波动感，所以排除黏膜下脓肿（E错）。